在直肠息肉中，下列哪种癌变率最高
A. 儿童性息肉
B. 炎性息肉
C. 绒毛状腺瘤
D. 混合性腺瘤
E. 管状腺瘤

正确答案：C。绒毛状腺瘤

解析：在直肠息肉中，癌变率最高的是绒毛状腺瘤（C对）。儿童性息肉（A错）、炎性息肉（B错）一般无癌变倾向。混合性腺瘤（D错）、管状腺瘤（E错）约半数癌变，但癌变率没有绒毛状腺瘤高。